患者妊娠2个月，证见食少便软，面色萎白，语声低微，四肢乏力，舌质淡，脉细缓。治疗方剂应首选
A. 四君子汤
B. 四物汤
C. 八珍汤
D. 当归补血汤
E. 归脾汤

正确答案：A。四君子汤

解析：本证乃脾胃之气受损，使其受纳与运化无力所致。脾胃为后天之本，气血生化之源。脾胃虚弱，气血生化不足，故气短乏力、语声低微、面色萎白；胃主受纳，脾主运化，胃气虚弱，则纳谷减少；脾失健运，湿从内生，故大便溏薄；舌质淡、苔薄白、脉虚缓皆为脾胃气虚之象。其治当补益脾胃之气，脾胃健旺，则诸症除矣，宜用四君子汤（A对）。四物汤（B错）的功用为补血和血，主治营血虚滞证。八珍汤（C错）的功用为益气补血，主治气血两虚证。当归补血汤（D错）的功用为补气生血，主治血虚发热证。归脾汤（E错）的功用为益气补血，健脾养心，主治心脾气血两虚证；脾不统血证。